办公场所的主要特点
A. 工作人员密集、停留时间短、流动性较大
B. 工作人员密集、停留时间长、流动性较大
C. 工作人员相对集中、停留时间长、流动性较小
D. 工作人员相对集中、停留时间短、流动性较大
E. 工作人员相对集中、停留时间长、流动性较大

正确答案：C。工作人员相对集中、停留时间长、流动性较小

解析：本题考查办公场所的主要特点。办公场所是指管理或专业技术人员处理（或办理）某种特定事务的室内工作环境。如公职人员、商务职员和企事业单位专业技术或管理人员履行职责的办公环境。其主要特点包括：1.办公人员相对集中，流动性较小；2.办公人员滞留时间长（C对ABDE错），活动范围小；3.办公场所分布范围广泛，基本条件和卫生状况相差较大；4.办公场所中存在诸多影响人体健康的不利因素。